以下哪项是氯丙嗪的禁忌证
A. 癫痫
B. 焦虑症
C. 低温麻醉
D. 顽固性呃逆
E. Ⅰ型精神分裂症

正确答案：A。癫痫

解析：氯丙嗪能降低惊厥阈，诱发癫痫，故有癫痫者禁用。掌握“氯丙嗪”知识点。